男，26岁。腹泻半天，于8月15日来诊。腹泻30多次，开始为稀便，后为水样便，继之多次呕吐。查体：T36.5℃，P110次/分，BP60/40mmHg，神志清楚，皮肤干燥，弹性差。腹软，无压痛。粪常规：水样便，镜检WBC0～3/HP，RBC0～2/HP。最可能的诊断是
A. 胃肠型细菌性食物中毒
B. 阿米巴痢疾
C. 急性细菌性痢疾
D. 溃疡性结肠炎
E. 霍乱

正确答案：E。霍乱

解析：患者青年男性，腹泻半天就诊。腹泻30多次，开始为稀便，后为水样便，继之多次呕吐（霍乱典型症状）。查体：T36.5℃（正常腋温36～37℃），P110次/分（正常值60～100次/分），BP60/40mmHg（正常值90～120/60～80mmHg），神志清楚，皮肤干燥，弹性差（脱水症状）。腹软，无压痛（排除溃疡型结肠炎）。粪常规：水样便，镜检WBC0～3/HP（正常镜下不可见，排除细菌性疾病），RBC0～2/HP（正常＜3/HP，排除消化道出血性疾病）。结合患者症状、体征及实验室检查，考虑诊断为霍乱（E对）。胃肠型细菌性食物中毒（A错）临床表现以急性胃肠炎为主，如恶心、呕吐、腹痛、腹泻等。葡萄球菌食物中毒呕吐较明显，呕吐物含胆汁，有时带血和粘液。腹痛以上腹部及脐周多见。腹泻频繁，多为黄色稀便和水样便。侵袭性细菌引起的食物中毒，可有发热、腹部阵发性绞痛和粘液脓血便。副溶血弧菌食物中毒的部分病例大便呈血水样。阿米巴痢疾（B错）病变主要侵犯右侧结肠，大便为脓血便，有恶臭，亦可呈水样或轿水样便。粪便或结肠镜取溃疡渗出物检查可找到溶组织阿米巴滋养体或包囊。血清抗阿米巴抗体阳性。急性细菌性痢疾（C错）症状主要为起病急，畏寒，发热，恶心，呕吐，同时或数小时后出现腹痛，初见于脐周或全腹，后转为左下腹，体检常有左下腹压痛。腹泻频繁，初为黄稀便，后为粘液及脓血，量少，伴里急后重。溃疡性结肠炎（D错）多表现为腹泻及黏液脓血便，多有左下腹或下腹阵痛，亦可累及全腹，常有里急后重，无呕吐。